当归采收加工中所用的加工方法是
A. 烘干
B. 阴干
C. 煤火熏干
D. 晒干
E. 烟火慢慢熏干

正确答案：E。烟火慢慢熏干

解析：本题考查的是当归的采收加工。当归采收加工中所用的加工方法是烟火慢慢熏干（E对）。当归【采收加工】一般栽培至第2年秋末采挖，除去茎叶、须根及泥土，放置，待水分稍蒸发后根变软时，捆成小把，上棚，以烟火慢慢熏干。藁本【采收加工】秋季茎叶枯萎或次春出苗时采挖，除去泥沙，晒干（D错）或烘干（A错）。商陆【采收加工】秋季至次春采挖，除去须根及泥沙，切成块或片，晒干或阴干（B错）。